右下腹痛，升结肠有一肿物，腹腔内无积液，下列最适宜的治疗是
A. 全结肠切除
B. 结肠近段+盲肠切除
C. 右半结肠切除术＋一期缝合
D. 升结肠局段性切除
E. 右半结肠切除+回肠造瘘

正确答案：C。右半结肠切除术＋一期缝合

解析：患者右下腹痛，升结肠有一肿物，符合右侧结肠癌的典型表现，手术治疗最合理的是有半结肠切除术，在术前应做好胃肠减压、纠正水和电解质紊乱以及酸碱失衡的准备，术后做一期缝合，综上所述，应为半结肠切除术＋一期缝合（C对）。